取供试品约50mg，加稀盐酸1ml使溶解，加亚硝酸钠试液数滴和碱性β-萘酚试液数滴，生成橙色或猩红色沉淀用来鉴别
A. 对乙酰氨基酚
B. 盐酸普鲁卡因
C. 盐酸利多卡因
D. 诺氟沙星
E. 盐酸氯丙嗪

正确答案：B。盐酸普鲁卡因